《中国药典》规定，应检查内源性毒性成分的药材和饮片有
A. 白芍
B. 桔梗
C. 制川乌
D. 附子
E. 制草乌

正确答案：C、D、E。制川乌；附子；制草乌

解析：本题考查的是中药内源性毒性成分的检查。《中国药典》规定，应检查内源性毒性成分的药材和饮片有制川乌（C对）、附子（D对）与制草乌（E对）。中药中主要的内源性有毒、有害特质是指中药本身所含的具有毒副作用的化学成分。这些化学成分大多为生物的次生代谢产物，如：（1）肾毒性成分马兜铃酸，主要存在于马兜铃科马兜铃属的关木通、广防己、青木香、马兜铃、天仙藤、朱砂莲等药材中。（2）肝毒性成分吡咯里西啶生物碱，主要存在于千里光、佩兰等药材中。（3）有些成分具双重作用，即在一定剂量内能产生药效，而配伍不当或服用过量时可产生不同程度的毒副作用，如乌头碱、苦杏仁苷、士的宁、斑蝥素等，朱砂、雄黄、信石等药材中所含的成分。《中国药典》对毒性成分的测定多采用高效液相色谱法，如制川乌、制草乌、附子中的双酯型生物碱（以含新乌头碱、次乌头碱、乌头碱的总量计），马钱子中的士的宁，斑蝥中的斑蝥素等。千里光中的阿多尼弗林碱、川楝子和苦楝皮中的川楝素等毒性成分测定采用高效液相色谱-串联质谱法，解决了常规高效液相色谱法灵敏度较低、分离不理想的问题。有毒中药药材加工成饮片后，毒性成分减少，如《中国药典》规定乌头碱、次乌头碱和新乌头碱的总量在川乌药材中应为0.050%～0.17%，在制川乌饮片中不得过0.040%；士的宁在马钱子药材中应为1.20%～2.20%，在马钱子粉中应为0.78%～0.82%。